儿童中枢神经系统白血病，最常见的是
A. 急性粒细胞白血病
B. 急性单核细胞白血病
C. 急性巨核细胞白血病
D. 急性淋巴细胞白血病
E. 急性红白血病

正确答案：D。急性淋巴细胞白血病

解析：中枢神经系统白血病（CNSL）由于化疗药物难以通过血脑屏障，隐藏在中枢神经系统的白血病细胞不能有效被杀灭，因而引起CNSL。CNSL可发生在疾病各个时期，但常发生在治疗后缓解期。以急淋白血病最常见，儿童尤甚（D对）。临床上轻者表现头痛、头晕，重者有呕吐、颈项强直，甚至抽搐、昏迷均未提及（ABCE错）。